雄激素
A. 使阴道上皮细胞增生角化
B. 使阴道上皮细胞脱落加快
C. 使进阴毛和腋毛生长
D. 使卵泡开始发育
E. 使黄体形成

正确答案：C。使进阴毛和腋毛生长

解析：雄激素的生理作用，青春期开始，雄激素分泌增加，促使阴蒂、阴唇和阴阜发育，促进阴毛、腋毛生长。掌握“女性生殖系统生理”知识点。